肝癌的手术指征是
A. 肝癌局限于一侧肝叶或肝段内
B. Child-Pugh肝功能分级属B级或C级
C. 大量腹水
D. AFP>100mg/L
E. 胆红素过高

正确答案：A。肝癌局限于一侧肝叶或肝段内

解析：肝癌对化疗和放疗不敏感，治疗性切除术是目前治疗肝癌最有效的方法之一，肝癌局限于一侧肝叶或肝段内满足手术安全性评估，可以进行手术（A对）；Child-PughA级；或B级，经短期护肝治疗后肝功能恢复到A级（B错）是实施手术切除的必要条件。大量腹水、AFP＞100mg/L、胆红素过高均不是肝癌的手术指征（CDE错）。